患者，女，55岁，2型糖尿病2年。近期调整降糖治疗方案后，反复出现泌尿与生殖系统感染。排除疾病因素后，可能引起该不良反应的降糖药物是
A. 利拉鲁肽
B. 达格列净
C. 胰岛素
D. 格列美脲
E. 二甲双胍

正确答案：B。达格列净

解析：本题考查口服降糖药的不良反应。钠-葡萄糖协同转运蛋白-2抑制剂（如达格列净）（B对）的主要不良反应有低血压、泌尿与生殖系统感染、酮症酸中毒等。